用常规培养法与荧光抗体法对同一批肉制品沙门菌样品进行检测，欲比较两种方法的检测结果是否有差别，宜选用
A. 四格表资料配对χ²检验
B. 两样本资料χ²检验
C. 行×列表资料χ²检验
D. 配对t检验
E. 配对设计的符号秩和检验

正确答案：A。四格表资料配对χ²检验